女，35岁。来医院健康体检。查体：BP130/80mmlHg。身高165cm，体重75kg，肝脾肋下未触及。实验室检查：ALT75U/L，AST40U/L，Y-GT40U/L。B超：中度脂肪肝。该患者肝内蓄积的甘油三酯的主要来源是
A. 小肠细胞合成
B. 生酮氨基酸转变
C. 肝细胞合成
D. 脂肪组织转运
E. 脂肪组织分解

正确答案：C。肝细胞合成

解析：患者青年女性，查体：身高165cm，体重75kg（BMI=27.8.提示超重），实验室检查：ALT75U/L（轻度升高，正常高值40U/L），AST40U/L（正常，正常高值40U/L），Y-GT40U/L（轻度升高，正常高值32U/L）。B超示中度脂肪肝。结合患者一般情况、实验室检查即影像学检查，易诊断为中度脂肪肝。各种原因所致的脂类吸收异常、肝细胞甘油三酯合成增加（C对）及甘油三酯运出肝细胞减少是导致脂肪肝发生的重要病理生理环节，肝内甘油三酯主要来源是肝细胞合成（C对）。